某女，50岁，体胖，患高血压病，证属脾虚湿盛、痰浊内阻，如蒙如裹，胸脘闷闷。医师处以半夏天麻丸，此因该成药的功能有
A. 健脾
B. 祛湿
C. 潜阳
D. 化痰
E. 息风

正确答案：A、B、D、E。健脾；祛湿；化痰；息风

解析：本题考查的是半夏天麻丸的功能。体胖，患高血压病，证属脾虚湿盛、痰浊内阻，如蒙如裹，胸脘闷闷。医师处以半夏天麻丸，此因该成药的功能有健脾（A对）、祛湿（B对）、化痰（D对）与息风（E对）。半夏天麻丸：【功能】健脾祛湿，化痰息风。脑立清丸：【功能】平肝潜阳（C错），醒脑安神。